气之主为
A. 心
B. 脾
C. 肺
D. 肝
E. 肾

正确答案：C。肺

解析：肺主气，主呼吸之气和全身之气。肺通过呼吸运动，不断的呼浊吸清，吐故纳新，实现机体与外界环境之间的气体交换。肺吸入的自然界清气与脾胃运化的水谷之精化生的水谷之气相合成宗气，宗气是一身之气的重要组成部分，关系着一身之气的盛衰；肺有节律的呼吸，调节着气的升降出入运动，从而调畅全身气机。（C对）。心（A错）的主要生理功能：心主血脉和心藏神。脾（B错）的主要生理功能：主运化和主统血。肝（D错）的主要生理功能：主疏泄和主藏血。肾的生理功能：肾主藏精；肾主水；肾主纳气。肾（E错）主纳气，指肾气的封藏作用在呼吸运动中的具体体现。肾气充沛，摄纳有权，则呼吸均匀和调，气息深深，与肺，一呼一吸，共同完成呼吸运动，所以肾为气之根。